患者，女，24岁。有先天性乳头凹陷史。近1月来发现右乳晕内侧有一直径约3cm肿块，局部疼痛不适，形态不规则，边界尚清，质地硬韧，挤压后可见白色脂汁样物质自乳头溢出。应首先考虑的是
A. 乳晕部痈疖
B. 乳腺癌
C. 浆细胞性乳腺炎
D. 导管内乳头状瘤
E. 乳房部漏管

正确答案：C。浆细胞性乳腺炎

解析：该题考查粉刺性乳痈及其鉴别诊断。粉刺性乳痈即西医的浆细胞性乳腺炎，多发生于非哺乳期、非妊娠期，病人多有先天性乳头凹陷，多单侧乳房发作，早期即开始有乳头溢液，肿块位于乳晕区，局部疼痛不适，肿块直径大多小于3cm，形状不规则，质地硬韧，题中患者符合这些特征，故考虑浆细胞性乳腺炎（C对）。